女，35岁，逐渐出现活动力下降半年，类风湿性关节炎病史5年，经规律使用NSAIDs药物症状控制尚可，查体：口唇苍白，双肺呼吸音清，未闻及干湿啰音，心率85次/分，P₂亢进，分裂，三尖瓣听诊区可闻及2/6级收缩期杂音，双下肢无水肿，该患者最可能出现的情况是
A. 肺血栓栓塞症
B. 间质性肺炎
C. 肺动脉高压
D. 贫血性心脏病
E. 感染性心内膜炎

正确答案：C。肺动脉高压

解析：患者青年女性，逐渐出现活动力下降半年，类风湿性关节炎病史5年（结缔组织疾病免疫调节作用可能参与IPAH病理过程），经规律使用NSAIDs药物症状控制尚可，查体：口唇苍白，双肺呼吸音清（排除肺部炎症性疾病），未闻及干湿啰音，心率85次/分（正常值60～100次/分），P₂亢进，分裂（提示肺动脉高压），三尖瓣听诊区可闻及2/6级收缩期杂音（肺动脉高压三尖瓣反流），双下肢无水肿（排除右心衰竭体循环淤血）。综合患者病史及体征，最有可能出现的情况是肺动脉高压（C对）。肺血栓栓塞症（A错）患者表现为心动过速，舒张期奔马律，肺动脉第二音亢进，主动脉瓣及肺动脉瓣有第二音分裂，休克、发绀、颈静脉怒张、肝大。肺部湿啰音、胸膜摩擦音、喘息音及肺实变的体征。间质性肺炎（B错）患者表现为刺激性干咳，胸片磨玻璃影，呼吸急促、发绀、双肺中下部可闻及Velcro 啰音，有杵状指趾。贫血性心脏病（D错）影像学检查证明心脏扩大、心电图呈缺血性ST-T改变或梗死样改变、诱发或加重心绞痛发作、有心功能不全或充血性心力衰竭表现。感染性心内膜炎（E错）患者有不同程度的发热、热型不规则、热程较长，个别患者无发热；此外患者有疲乏、盗汗、食欲减退、体重减轻、关节痛、皮肤苍白等表现；原有的心脏杂音可因心脏瓣膜的赘生物而发生改变，出现粗糙响亮、呈海鸥鸣样或音乐样的杂音；原无心脏杂音者可出现音乐样杂音，约一半患者由于心瓣膜病变、中毒性心肌炎等导致充血性心力衰竭，出现心音低钝、奔马律等。